男，33岁。活动时气短心前区疼痛1年。查体：BP146/80mmHg，双肺呼吸音清，心率78次/分，律齐，胸骨左缘第3～4肋间可闻及3/6级收缩期喷射性杂音。超声心动图示舒张期间室间隔与左室后壁厚度之比＞1.5。该患者最适宜的治疗药物是
A. 硝酸甘油
B. 地高辛
C. 美托洛尔
D. 氢氯噻嗪
E. 氨茶碱

正确答案：C。美托洛尔

解析：患者青年男性，活动时气短、心前区疼痛，血压稍高（BP146/80mmHg），胸骨左缘第3～4 肋间可闻及3/6级收缩期喷射性杂音（提示流出道梗阻），超声心动图示舒张期间室间隔与左室后壁厚度之比＞1.5（肥厚型心肌病特征性超声心动图改变），因此该患者最可能的诊断是肥厚型梗阻性心肌病。该患者最适宜的治疗药物是美托洛尔（C对）。美托洛尔为β受体拮抗剂，可改善心肌松弛，增加心室舒张期充盈时间，减少室性及室上性心动过速，为肥厚型梗阻性心肌病的首选用药。硝酸甘油（A错）为硝酸酯类药物，扩张小静脉，减轻心脏前负荷，可加重心室流出道梗阻，因此不能用于肥厚型梗阻性心肌病患者的治疗。地高辛（B错）为洋地黄制剂，可增强心肌收缩力，而肥厚型梗阻性心肌病主要是舒张功能受损，若服用地高辛可加重患者症状，故患者慎用地高辛。氢氯噻嗪（D错）主要针对于肥厚型梗阻性心肌病导致的心力衰竭的治疗。氨茶碱（P33）（E错）多用于支气管哮喘的治疗，也可用于急性心力衰竭的治疗。